男，45岁。近3个月自觉轻度乏力。母亲HBsAg（+）。实验室检査：血ALT420U/L，TBil64μmol/L，PTA88%，HBsAg（+），HBeAg（+），抗HBc（+），HBVDNA4.5x10⁵copies/ml。首选治疗药物是
A. 恩替卡韦
B. 护肝片
C. 茵栀黄口服液
D. 甘草酸二胺
E. 干扰素

正确答案：A。恩替卡韦

解析：中年男性患者，轻度乏力3个月（慢性肝炎一般表现），母亲HBsAg（+）（乙肝家族史）。实验室检査：ALT420U/L（正常参考值0～40U/L），TBil64μmol/L（正常参考值3.4～17.1umol/L），HBVDNA4.5×10⁵拷贝/ml（﹥10⁵拷贝/ml），根据患者的病史、临床表现和实验室检查，患者为慢性乙型肝炎，抗病毒治疗药物选择以核苷类药物或干扰素类，核苷类药物包括拉米夫定、恩替卡韦（A对）、阿德福韦酯、特诺福韦等，以改善肝功能并延缓或减少肝移植的需求，患者血TBil64μmol/L，大于2×ULN，不宜使用干扰素（E错）。护肝药物（B错）缺乏循证医学证据，过多使用加重肝负担。茵栀黄口服液（C错）为退黄药物，用于肝胆湿热所致的黄疸，可以改善胆汁淤积，为辅助用药。甘草酸制剂（D错）是改善和恢复肝功的降酶药，有降低转氨酶的作用，不作为首选用药。